上腹部手术的拆线日期是
A. 4～5日
B. 6～7日
C. 7～9日
D. 10～12日
E. 14日

正确答案：C。7～9日

解析：缝线的拆除时间，可根据切口部位、局部血液供应情况、病人年龄、营养状况等来决定。一般头、面、颈部在术后4～5日拆线，下腹部、会阴部在术后6～7日拆线，胸部、上腹部、背部、臀部手术术后7～9日拆线（C对），四肢手术10～12日拆线（近关节处可适当延长），减张缝线14日拆除。